上颌骨骨化中心向哪个方向进行生长形成腭突
A. 向前
B. 向后
C. 向内
D. 向外
E. 向上

正确答案：C。向内

解析：上颌骨的骨化中心向内形成腭突。掌握“唾液腺与颌骨的发育”知识点。